棘突长，斜向后下呈叠瓦状排列的是
A. 颈椎
B. 腰椎
C. 寰椎
D. 胸椎
E. 隆椎

正确答案：D。胸椎

解析：胸椎棘突较长，向后下方倾斜，各相邻棘突呈叠瓦状排列（D对）。